《药典》规定，含挥发性成分贵重中药的水分测定方法是
A. 烘干法
B. 甲苯法
C. 薄层色谱法
D. 减压干燥法
E. 高效液相色谱法

正确答案：D。减压干燥法

解析：本题考查的是水分测定法。《药典》规定，含挥发性成分贵重中药的水分测定减压干燥法（D对）。《中国药典》规定水分测定法有五种：第一法（费休氏法）包括容量滴定法和库仑滴定法。第二法（烘干法（A错））适用于不含和少含挥发性成分的药品，如三七、广枣等。第三法（减压干燥法）适用于含挥发性成分的贵重药品，如厚朴花、蜂胶等。第四法（甲苯法（B错））适用于含挥发性成分的药品，如肉桂、肉豆蔻、砂仁等。第五法（气相色谱法），如辛夷。薄层色谱法（C错）可用于分离、定性及定量测定。高效液相色谱法（E错）是目前中药含量测定中最常用的方法。